PPI）作用特点的说法正确的有
A. 艾司奥美拉唑可与抗菌药物和铋剂合用根除幽门螺杆菌
B. 幽门螺杆菌对奥美拉唑极少发生耐药现象
C. 停用PPI后引起的基础胃酸分泌反弹持续时间较长
D. 长期或高剂量使用PPI可增加患者骨折风险
E. 使用PPI前应排除胃与食管恶性病变的可能，以免掩盖症状造成误诊

正确答案：A、B、C、D、E。艾司奥美拉唑可与抗菌药物和铋剂合用根除幽门螺杆菌；幽门螺杆菌对奥美拉唑极少发生耐药现象；停用PPI后引起的基础胃酸分泌反弹持续时间较长；长期或高剂量使用PPI可增加患者骨折风险；使用PPI前应排除胃与食管恶性病变的可能，以免掩盖症状造成误诊

解析：本题考查质子泵抑制剂（ PPI）作用特点。艾司奥美拉唑为奥美拉唑的S-异构体，适用于胃及十二指肠溃疡、胃食管反流病、卓-艾综合征、消化性溃疡急性出血、急性胃黏膜病变出血，与抗菌药物联合用于Hp根除治疗（A对）；PPI极少发生耐药现象（B对），但停药后引起的基础胃酸分泌反弹持续时间较长（C对），可达2个月；长期和较高剂量使用PPI可使骨折风险升高（D对），老年患者风险更高；骨折风险可能与剂量、用药时间相关。PPI抑酸分泌作用强大而持久，用药前需排除胃与食管恶性病变的可能，以免因症状缓解而延误诊断（E对）。